患者，男，45岁。左上臂内侧有一肿块，呈半球形，暗红色，质地柔软，状如海绵，压之可缩小。应首先考虑的是
A. 气瘤
B. 筋瘤
C. 脂瘤
D. 血瘤
E. 肉瘤

正确答案：D。血瘤

解析：气瘤是以皮肤间发生单个或多个柔软结核，按之凹陷，放手凸起，状若有气，皮色如常或褐色斑为主要表现的肿瘤性疾病（A错）。筋瘤是以筋脉色紫、盘曲突起如蚯蚓状、形成团块为主要表现的浅表静脉病变（B错）。脂瘤多因痰凝气结而生，常发于投面、项背、臀部等处，小的似豆，大的如鸡蛋，生长缓慢，软而不硬，皮色淡红，推之可移动，顶端常有稍带黑色的小口，可挤压出有臭味的豆腐渣状物质（C错）。血瘤是指体表血络扩张，纵横丛集而形成的肿瘤。可发生于身体任何部位，大多数为先天性，其特点是病变局部色泽鲜红或暗紫，或呈局限性柔软肿块，边界不清，触之如海绵状。题中患者肿块儿色暗红，质地柔软，状如海绵，压之可缩小，符合血瘤的特征（D对）。肉瘤是发生于皮里膜外，由脂肪组织过度增生而形成的良性肿瘤。其特点是软似棉，肿似馒，皮色不变，不紧不宽，如肉之隆起。（E错）。